血吸虫病急性虫卵结节的叙述，错误的是
A. 结节中有抗原抗体复合物
B. 未成熟虫卵病变较轻
C. 结节中可见大量脓细胞
D. 肉眼呈灰黄色，局限性结节状病灶
E. 结节后期有肉芽组织增生

正确答案：C。结节中可见大量脓细胞

解析：虫卵沉着所引起的损害是血吸虫病最主要的病变，沉着的虫卵按其发育过程可分为未成熟卵和成熟卵两种，前者因毛蚴不成熟，无毒液分泌，所引起的病变轻微（B对）。虫卵沉着形成的虫卵结节按病变发展过程，可分为急性虫卵结节和慢性虫卵结节。急性虫卵结节肉眼观呈灰黄色、局限性结节状病灶（D对），镜下见结节中央有1～2个成熟虫卵，虫卵表面可见抗原抗体复合物（A对），虫卵周围是一片无结构的颗粒状坏死物质及大量嗜酸性粒细胞浸润（C错，为本题正确答案）。随着病程的发展，后期虫卵周围有肉芽组织增生，可见淋巴细胞、巨噬细胞、嗜酸性粒细胞等炎细胞浸润，以嗜酸性粒细胞为主。